初孕妇，30岁。妊娠38周，双胎妊娠，双头位。产程进展顺利，第1个胎儿娩出后，第2个胎儿胎心音突然消失，伴有阴道多量流血，腹部见子宫轮廓清楚，宫底达脐上3指。此时最可能发生的情况是
A. 胎盘早剥
B. 子宫破裂
C. 先兆子宫破裂
D. 前置胎盘
E. 羊水栓塞

正确答案：A。胎盘早剥

解析：双胎妊娠，第2个胎儿（第一胎儿娩出过快，宫腔内压力骤减为胎盘早剥的病因之一）胎心音突然消失，伴有阴道多量流血，腹部见子宫轮廓清楚（排除子宫破裂），宫底达脐上3指（妊娠28周末的位置），最可能为胎盘早剥。胎盘早剥的典型表现：阴道流血、腹痛，伴有子宫张力增高和子宫压痛，子宫呈板状硬，胎位不清。前置胎盘（D错）典型症状为妊娠晚期或临产后发生无诱因、无痛性反复阴道流血。子宫软，无压痛，轮廓清楚，大小与孕周相符（P148）。先兆子宫破裂（C错）常见于产程长、有梗阻性难产因素的产妇。表现为：①子宫呈强直性或痉挛性过强收缩，产妇烦躁不安，呼吸、心率加快，下腹剧痛难忍。②病理缩复环为常见典型体征。③膀胱受压充血，出现排尿困难及血尿。④胎心率加快或减慢或听不清（P212）。羊水栓塞（E错）为胎盘早剥的严重并发症，主要表现为突然出现的肺动脉高压、低氧血症及弥散性血管内凝血(DIC），严重者甚至出现心衰、休克等多器官功能衰竭表现（P209）。